主要有效成分是绿酸原、异绿原酸的清热药是
A. 知母
B. 黄芩
C. 苦参
D. 金银花
E. 连翘

正确答案：D。金银花

解析：本题考查的是清热药的主要药理作用。主要有效成分是绿酸原、异绿原酸的清热药是金银花（D对）。金银花中主要含有木犀草苷和有机酸类化合物。《中国药典》规定，金银花含木犀草苷不得少于0.050%，含绿原酸不得少于1.5%，含酚酸类的总量不得少于3.8%。绿原酸和异绿原酸是金银花的主要抗菌有效成分。知母（A错）中主要化学成分为甾体皂苷和芒果苷，还含有木脂素、甾醇、鞣质、胆碱等成分。《中国药典》上将知母皂苷BⅡ和芒果苷定为知母药材的质量控制成分，要求知母皂苷BⅡ含量不得少于3.0%，芒果苷的含量不少于0.7%。知母具有解热、抗炎、降血糖等作用。黄芩（B错）中主要成分及其化学结构：从黄芩中分离出来的黄酮类化合物有黄芩苷（含4.0%～5.2%）、黄芩素、汉黄芩苷、汉黄芩素等20种成分。其中黄芩苷是主要有效成分，具有抗菌、消炎作用。《中国药典》以黄芩苷为指标成分进行含量测定要求药材含量不得少于9.0%，饮片含量不得少于8.0%。苦参（C错）中主要生物碱及其化学结构：苦参所含主要生物碱是苦参碱和氧化苦参碱，《中国药典》以其为指标成分进行鉴别和含量测定，含量测定要求苦参碱和氧化苦参碱总量不得少于1.2%。此外还含有羟基苦参碱、N-甲基金雀花碱、安那吉碱、巴普叶碱和去氢苦参碱（苦参烯碱）等。这些生物碱都属于双稠哌啶类。苦参总生物碱具有抗肿瘤、抗病原微生物、抗心律失常、解热、抗炎、抗变态反应和调节免疫等作用。连翘（E错）中的木脂素类成分多为双环氧木脂素及木脂内酯，《中国药典》以挥发油、连翘苷和连翘酯苷A为指标成分进行含量测定，要求青翘的挥发油含量不得少于2.0%（ml/g），青翘的连翘酯苷A含量不得少于3.5%，老翘含连翘酯苷A不得少于0.25%；对连翘苷含量要求不得少于0.15%。